药学咨询服务是执业药师参与全程化药物治疗的需要，对指导患者安全、有效、合理用药具有重大意义。执业药师应向患者提供咨询服务活动中需要特别关注的问题包括
A. 患者疾病状况，比如肝肾功能指标，既往病史等
B. 尊重患者意愿，保护患者隐私，不得将咨询信息用于商业目的
C. 对老年人提供咨询服务时应适当的多使用文字、图片的形式
D. 咨询要以容易理解的语言来解释，尽量使用带数字的术语
E. 不能当场解答的问题，应进一步查询相关资料后给予答复

正确答案：A、B、C、E。患者疾病状况，比如肝肾功能指标，既往病史等；尊重患者意愿，保护患者隐私，不得将咨询信息用于商业目的；对老年人提供咨询服务时应适当的多使用文字、图片的形式；不能当场解答的问题，应进一步查询相关资料后给予答复

解析：本题考查的是应用药品需特别关注的问题。药学咨询服务是执业药师参与全程化药物治疗的需要，对指导患者安全、有效、合理用药具有重大意义。执业药师应向患者提供咨询服务活动中需要特别关注的问题包括患者疾病状况，比如肝肾功能指标，既往病史等（A对）；尊重患者意愿，保护患者隐私，不得将咨询信息用于商业目的（B对）；对老年人提供咨询服务时应适当的多使用文字、图片的形式（C对）；不能当场解答的问题，应进一步查询相关资料后给予答复（E对）。用药咨询中执业药师需特别关注的问题：（1）对特殊人群需注意的事项：老年人由于认知能力下降，因此向他们做解释时语速宜慢，还可适当地多用些文字、图片形式以方便他们理解和记忆。对于女性咨询患者，还要注意问询是否已经怀孕或有否准备怀孕的打算；是否正在哺乳，这些都是需要在解答问题中特别要注意的地方。患者的疾病状况也是不能忽视的问题。比如，患者有肝、肾功能障碍，会影响药物的代谢和排泄，容易导致药品不良反应的发生和中毒。（2）解释的技巧：对于一般患者的咨询要以容易理解的医学术语来解释。对患者来说，尽量使用描述性语言以便患者能正确理解，还可以采取语言与书面解释方式同时并用。尽量不用带数字的术语来表示（D错）。（3）尊重患者的意愿，保护患者的隐私：在药学实践工作中，一定要尊重患者的意愿，保护患者的隐私，更不可将咨询档案等患者的信息资料用于商业目的。（4）及时回答不拖延：对于患者所咨询的问题，能够给予当即解答的就当即解答，不能当即答复的，或者不十分清楚的问题，不要冒失地回答，要问清对方何时需要答复；待进一步査询相关资料以后尽快给予正确的答复。拖延太久的答案时常会失去它的意义。因此，如何有效地利用资源，用较少的时间来回答问题，不仅受条件设施的影响，还与执业药师自身的知识结构和表达能力有关。